含牙囊肿与萌出囊肿的共同上皮来源为
A. 牙板上皮剩余
B. Malassez上皮剩余
C. 牙龈上皮
D. 缩余釉上皮
E. Serres上皮剩余

正确答案：D。缩余釉上皮

解析：缩余釉上皮发生的囊肿有含牙囊肿、萌出囊肿以及炎性牙旁囊肿。掌握“牙源性囊肿”知识点。